处理颅内压增高，哪一项是错误的
A. 频繁呕吐时宜禁食
B. 限制输液量及速度
C. 便秘4天以上给予高位、高压灌肠
D. 静点地塞米松
E. 早期行病因治疗

正确答案：C。便秘4天以上给予高位、高压灌肠

解析：处理颅内压增高，应该用轻泻剂来疏通大便，不可作高位灌肠，以免颅内压骤然增高（C错，为本题正确答案）；频繁呕吐者应暂禁食（A对），以防吸入性肺炎；补液应量出为入（B对），补液过多可促使颅内压增高恶化；可静点地塞米松（D对），可减轻脑水肿，有助于缓解颅内压增高；查明病因者，应早期行病因治疗（E对），以防颅内压进一步增高。